下列哪种手段不能控制混杂偏倚
A. 随机
B. 配比
C. 分层分析
D. 分级分析
E. 多因素分析

正确答案：D。分级分析